血液透析的适应证有
A. 急性肾衰
B. 慢性肾衰
C. 急性药物或毒物中毒
D. 高钙血症
E. 高尿酸血症

正确答案：A、B、C、D、E。急性肾衰；慢性肾衰；急性药物或毒物中毒；高钙血症；高尿酸血症